在物料的降速干燥阶段，不正确的表述是
A. 物料内部的水分及时补充到物料的表面
B. 改变空气状态及流速对干燥速度的影响不大
C. 干燥速率主要由受物料内部水分向表面的扩散速率所决定
D. 提高物料的温度可以加快干燥速率
E. 改善物料的分散程度可以加快干燥速率

正确答案：A。物料内部的水分及时补充到物料的表面